肺心病慢性呼吸衰竭患者，血气分析结果：pH7.18，PaCO₂75mmHg，PaO₂50mmHg，HCO₃⁻27.6mmol/L，BE-5mmol/L，其酸碱失衡类型是
A. 代谢性酸中毒
B. 呼吸性酸中毒
C. 呼吸性酸中毒合并代谢性酸中毒
D. 代谢性碱中毒
E. 呼吸性酸中毒合并代谢性碱中毒

正确答案：C。呼吸性酸中毒合并代谢性酸中毒

解析：呼吸性酸中毒是指因为呼吸功能障碍导致原发的PaCO₂升高所致的质子浓度增加，pH下降的的过程。患者肺心病慢性呼吸衰竭，肺通气换气功能障碍，体内CO₂潴留（PaCO₂ 75mmHg）（正常值35-45mmHg），PaCO₂（75mmHg）（正常值22-27mmol／L）升高，pH（7.18）（正常值7.35-7.45）下降失代偿，说明患者有呼吸性酸中毒。患者BE（剩余碱）（正常值0±2.3mmol／L）为-5mmol／L超过正常范围最低值，说明患者体内代谢性酸剩余，即代谢性酸中毒。（ C对）。代谢性碱中毒是指原发的血浆HCO₃⁻（22-27mmol／L）升高而引起的一系列病理生理过程，患者HCO₃⁻ 27.6mmol／L，经代偿公式（P552）计算，处于代偿极限内，认为患者无代谢性碱中毒（DE错）。呼吸性碱中毒是指由于过度使血浆通气PaCO₂下降引起的一系列病理生理过程，患者PaCO₂ 75mmHg，不符合呼吸性碱中毒（B错）。